下列脊髓上行纤维束中，属于一级感觉纤维束的是
A. 脊髓小脑前束
B. 脊髓小脑后束
C. 薄束
D. 楔小脑束
E. 脊髓丘脑侧束

正确答案：E。脊髓丘脑侧束

解析：在脊髓上行纤维束中，属于一级感觉纤维束的是脊髓丘脑侧束（E对），主要传递痛、温觉信息。